急性胆囊炎时触诊胆囊的表现为
A. 胆囊不肿大，明显黄疸
B. 胆囊不肿大，墨菲征阴性
C. 胆囊肿大实性感
D. 胆囊肿大囊性感有压痛
E. 胆囊肿大囊性感无压痛，黄疸渐进性加深

正确答案：D。胆囊肿大囊性感有压痛

解析：右上腹部稍膨隆，右肋下胆囊区有腹壁紧张、压痛及反跳痛，墨菲征阳性。伴胆囊积脓或胆囊周围脓肿者，于右上腹部可触及包块。如引起胆囊穿孔或胆汁性腹膜炎，可出现急性弥散性腹膜炎的表现（D对）。肝硬化时胆囊不肿大，明显黄疸（A错）。胆囊不肿大，墨菲征阴性为正常人（B错）。常见于急性胆囊炎、胆石症和胆囊癌等。胆囊触诊时可触及肿大的胆囊，并有囊性感或实体感，及明显压痛（C错）。当胰头癌压迫胆总管导致阻塞，出现黄疸进行性加深，胆囊显著肿大，但无压痛，称为库瓦西耶征阳性，又称无痛性胆囊增大征阳性（E错）。